男，50岁，为长期使用麻醉药品的门诊癌症患者。医院为了解治疗效果和用药安全状况，要求其定期进行复诊。根据相关规定，患者复诊间隔的最长期限是
A. 4个月
B. 6个月
C. 5个月
D. 2个月
E. 3个月

正确答案：E。3个月

解析：根据《处方管理办法》规定，医疗机构应当要求长期使用麻醉药品的门（急）诊癌症患者和中、重度慢性疼痛患者，每3个月复诊或者随诊一次。该门诊癌症患者复诊间隔的最长期限是3个月（E对）。